维生素D缺乏病可靠的早期诊断指标是
A. 血钙降低
B. 血磷降低
C. 血镁降低
D. 血清1，25-(OH)2-D3降低
E. 血碱性磷酸酶增高

正确答案：D。血清1，25-(OH)2-D3降低

解析：血清25-（0H）D3（正常值10～60μg/L）和1，25-（OH）2D3（正常值0.03～0.06μg/L）水平在佝偻病初期就已明显降低，为可靠的早期诊断指标。掌握“维生素D缺乏性佝偻病”知识点。